哪条动脉内流动的是静脉血？
A. 肺动脉
B. 腹腔干
C. 头臂干
D. 主动脉
E. 动脉

正确答案：A。肺动脉

解析：肺动脉（A对）内流动的是静脉血，肺动脉干由右心室发出，其分支输送静脉血。